女，39。呕血、黑便1天。既往肝炎病史20年。查体：贫血貌，巩膜轻度黄染，腹膨隆，脾肋下8cm，腹水征（+）。需要立即实施的措施中不包括的是
A. 静脉静滴血管加压素
B. 静脉滴注生长抑素
C. 急诊胃镜检查、止血
D. 开腹探查、止血
E. 输血输液

正确答案：D。开腹探查、止血

解析：患者长期肝炎病史，脾脏肿大、腹水，诊断为肝炎后肝硬化，门脉高压症。现患者上消化道大出血，诊断食管胃底静脉曲张破裂出血。患者有黄疸、腹水，考虑肝功能为Child-Pugh C级，此时如采用手术治疗，死亡率高达60%～70%，因此不可开腹探查止血（D错，为本题正确答案）。应当采用非手术治疗，包括①静脉滴注血管加压素（A对），收缩内脏血管，减慢出血速度；②静脉滴注生长抑素（B对），可抑制内脏高动力循环，降低出血速度；③急诊胃镜检查、止血（C对），此为急性出血的首选方法；④输血输液（E对）以补充血容量，防止休克。